铈量法使用的指示剂是
A. 结晶紫
B. 酚酞
C. 淀粉
D. 邻二氮菲
E. 甲基红

正确答案：D。邻二氮菲

解析：本题考查铈量法。邻二氮菲（D对）是铈量法的指示剂。铈量法是氧化还原滴定法的一种，以硫酸铈为滴定剂，以邻二氮菲为指示剂。结晶紫（A错）是非水碱量法的指示剂。酚酞（B错）是酸碱滴定法指示剂的一种。淀粉（C错）是碘量法的指示剂。甲基红（E错）是酸碱滴定法的指示剂。